与龈下牙石形成有关
A. 龈上菌斑
B. 附着性龈下菌斑
C. 非附着性龈下菌斑
D. 陈旧的龈上菌斑
E. 窝沟处龈上菌斑

正确答案：B。附着性龈下菌斑

解析：本题考查慢性牙周炎的病因，表现诊断及预后。附着性龈下菌斑（B对）：龈缘以下附着于牙根面的龈下菌斑，由龈上菌斑延伸到牙周袋内。其结构、成分与龈上菌斑相似，细菌种类增多，主要为革兰阳性球菌及杆菌、丝状菌，还可见少量革兰阴性短杆菌和螺旋体等。它与龈下牙石的形成、根面龋、根面吸收及牙周炎有关。